风心病二尖瓣狭窄伴房颤最易出现
A. 呼吸道感染
B. 心力衰竭
C. 心律不齐
D. 亚急性感染性心内膜炎
E. 栓塞

正确答案：E。栓塞

解析：风心病二尖瓣狭窄伴房颤最易出现血栓栓塞（E对），以脑栓塞最常见，约占2/3，亦可发生于四肢、脾、肾和肠系膜等动脉栓塞。